男，70岁。痰中带血1月余。吸烟10年，40支/天。胸部X线片：右肺门大块影伴右上肺不张。支气管镜见右上肺开口内新生物。该患者首选的下一步检查是
A. 头颅CT
B. 全身骨扫描
C. 肝、肾、肾上腺B型超声
D. 胸部CT
E. 腹部CT

正确答案：D。胸部CT

解析：老年男性患者，长期吸烟史，痰中带血（提示可能有肺癌），X线片示右肺门大块影伴右上肺不张（提示有支气管阻塞），支气管镜见右上肺开口内新生物（提示肿块位于右上肺开口处），结合患者病史、临床表现和相关检查，该患者最可能的诊断为中心型肺癌。该患者首选的下一步检查是胸部CT（D对），其不但可以显示病灶的局部影像特征，还可以评估肿瘤范围、肿瘤与邻近器官关系、淋巴结转移情况，为制订肺癌的治疗方案提供重要依据。头颅CT（A错）主要用于颅脑占位性病变的诊断。全身骨扫描（B错）主要用于肿瘤骨转移的诊断。肝、肾、肾上腺B型超声（C错）为一般辅助检查手段。腹部CT（E错）可以了解肺癌有无腹腔转移。